进行流感病毒的血清学诊断最常用的方法是
A. 抗体中和试验
B. 补体结合试验
C. 红细胞凝集试验
D. 血凝抑制试验
E. 荧光抗体试验

正确答案：D。血凝抑制试验